Bornträger's反应呈阳性的是
A. 酚羟基蒽醌
B. 苯胺
C. 苯酚
D. 苯
E. 萘酚

正确答案：A。酚羟基蒽醌

解析：本题考查醌类化合物的显色反应。Bornträger's反应呈阳性的是酚羟基蒽醌（A对）。Bornträger's反应：在碱性溶液中，羟基醌类颜色改变并加深，多呈橙、红、紫红及蓝色。如羟基蒽醌类化合物遇碱显红至紫红色，称为Bornträger's反应。生物碱共轭效应：当生物碱分子中氮原子的孤电子对与开电子基团共轭时，一般使生物碱的碱性减弱。常见的有苯胺（B错）和酰胺两种类型。苯酚（C错）为酚类化合物。